属于非核苷类的抗病毒药
A. 利巴韦林
B. 金刚烷胺
C. 齐夫多定
D. 奥司他韦
E. 更昔洛韦

正确答案：A、B、D。利巴韦林；金刚烷胺；奥司他韦

解析：本题考查抗病毒药的类型。非核苷类抗病毒药有利巴韦林（A对）、金刚烷胺（B对）、膦甲酸钠和奥司他韦（D对）。